血中哪一种胆红素增加会在尿中出现胆红素
A. 非结合胆红素
B. 结合胆红素
C. 肝前胆红素
D. 间接反应胆红素
E. 与清蛋白结合的胆红素

正确答案：B。结合胆红素